根据教育对象和实施途径的不同，医院健康教育和健康促进的形式不包括
A. 医护人员教育
B. 患者教育
C. 社区卫生服务中的健康教育
D. 社会性宣传教育
E. 职业人群健康教育

正确答案：E。职业人群健康教育